玻璃离子体的优点不包括
A. 良好的粘接性
B. 生物相容性
C. 释放氟离子
D. 耐溶解性
E. 良好的物理机械性能

正确答案：E。良好的物理机械性能

解析：玻璃离子体的优点是具有良好的粘接性、生物相容性、释放氟离子和耐溶解性。玻璃离子体的物理机械性能较差，弹性模量较低，脆性较大，抗张强度和抗压强度均小于复合树脂。美观性也较复合树脂差。掌握“牙体充填材料之玻璃离子及复合体”知识点。